某男，43岁。咳嗽气粗，痰多黄稠，严重时痰中夹血，甚至咳鲜血，伴胸闷烦热，汗出，口渴喜冷饮；舌质红，苔黄腻，脉滑数。该患者禁用的中药应是
A. 猪牙皂
B. 黄芩
C. 桑白皮
D. 橘红
E. 法半夏

正确答案：A。猪牙皂

解析：本题考查的是有毒、小毒中药的用法用量及调剂。咳嗽气粗，痰多黄稠，严重时痰中夹血，甚至咳鲜血，伴胸闷烦热，汗出，口渴喜冷饮；舌质红，苔黄腻，脉滑数。该患者禁用的中药应是猪牙皂（A对）。猪牙皂：有小毒。用法用量1～1.5g，多入丸散。外用适量，研末吹鼻取嚏或研末调敷患处。孕妇禁用。咯血、吐血者禁用。黄芩（B错）使用注意：本品苦寒燥泄，能伐生发之气，故脾胃虚寒、食少便溏者忌服。桑白皮（C错）使用注意：本品性寒，故寒痰咳喘者忌服。橘红（D错）使用注意：本品辛苦温燥，能耗气伤阴，故阴虚燥咳及久咳气虚者忌服。法半夏（E错）为半夏炮制品，长于燥湿。半夏，有毒。内服一般炮制后使用，3～9g。外用适量，磨汁涂或研末以酒调敷患处。不宜与川乌、制川乌、草乌、制草乌、附子同用；生品内服宜慎。